一般情况下，青霉素每日二次肌注能达治疗要求，因
A. t1/2为10～12h
B. 细菌受其一次杀伤后恢复细菌增殖力一般要6～12h
C. 维持有效浓度为6～12h
D. 相对脂溶性高，易进入宿主细胞
E. 在感染病灶停留时间为8～12h

正确答案：B。细菌受其一次杀伤后恢复细菌增殖力一般要6～12h